男，14岁。左胫骨近端疼痛2个月，呈进行性加重。X线片检査发现左胫骨干骺端骨膜反应呈“日光射线“形态。最可能的诊断是
A. 骨肉瘤
B. 骨巨细胞瘤
C. 骨软骨瘤
D. 骨结核
E. 骨囊肿

正确答案：A。骨肉瘤

解析：青少年男性患者，左胫骨近端疼痛，呈进行性加重，X线片检査发现左胫骨干骺端骨膜反应、呈“日光射线“形态（骨肉瘤典型影像学表现），结合患者症状和影像学表现，最可能的诊断是左胫骨近端骨肉瘤（A对）。骨巨细胞瘤（B错）X线片特征性表现为骨端偏心性、溶骨性、囊性破坏而无骨膜反应，病灶呈肥皂泡样改变。骨软骨瘤（C错）X线表现为干骺端的外生性骨性突起。骨结核（D错）多见于脊柱，常有低热盗汗等结核中毒症状，X线可见骨质破坏和椎间隙狭窄。骨囊肿（E错）好发于长管骨干骺端，多无明显症状，X线片常表现为干骺端圆形或椭圆形界限清楚的溶骨性病灶。